下列关于《新编药物学》的叙述，错误的是
A. 是由陈新谦、金有豫主编的
B. 是由人民卫生出版社出版的
C. 是我国目前知名度最高的药品集
D. 可查阅药品性状、药理作用及临床应用、用法和注意事项
E. 可以查阅疾病的诊断知识和药物治疗学理论

正确答案：E。可以查阅疾病的诊断知识和药物治疗学理论

解析：本题考查《新编药物学》。《新编药物学》由陈新谦、金有豫主编（A对），人民卫生出版社出版（B对），该书是国内知名度最高的药品集（C对）。《新编药物学》对国内外常用药品的性状、药理及应用、用法、注意事项及制剂均有简略的介绍可供查阅（D对）。该书并无疾病的诊断知识和药物治疗学理论（E错，为本题正确答案）。